下列慢性胃炎的病理改变，属于癌前病变的是
A. 黏膜重度萎缩，腺体减少
B. 假幽门腺化生
C. 伴或者不伴有肠上皮化生的慢性萎缩性胃炎
D. 重度不典型增生
E. 淋巴滤泡增生

正确答案：C。伴或者不伴有肠上皮化生的慢性萎缩性胃炎

解析：胃的肠上皮化生（C对）与胃癌的发生有一定关系，属于癌前病变。黏膜重度萎缩，腺体减少（A错）是慢性萎缩性胃炎（P188）的特征性表现，但不属于癌前病变。假幽门腺化生（P189）（B错）是胃黏膜的另一种化生，是指胃体部或底部的腺体壁细胞和主细胞被类似幽门腺的黏液分泌细胞所取代，与胃癌的发生关系不密切。重度不典型增生（D错）与原位癌难以截然划分，处理原则也基本一致（P103），因此重度不典型增生已经可以看做是癌，而不是癌前病变。淋巴滤泡增生（E错）常出现于淋巴结炎中，与胃癌的发生无关。